牵牛子的功效有
A. 泻下
B. 逐水
C. 去积
D. 蚀疮
E. 杀虫

正确答案：A、B、C、E。泻下；逐水；去积；杀虫